颏孔距正中线约
A. 不超过1cm
B. 1～1.5cm
C. 2～3cm
D. 3～5cm
E. 超过5cm

正确答案：C。2～3cm

解析：颏孔位于下颌体外侧面，成人多位于下颌第二前磨牙或下颌第一、第二前磨牙之间的下方，下颌体上、下缘中点微上方，距正中线约2～3cm。掌握“面部表面解剖”知识点。